以下哪种肿瘤是以形成牙骨质样组织为特征的肿瘤，常与一颗牙的牙根相连
A. 牙骨质增生症
B. 成牙骨质细胞瘤
C. 成釉细胞瘤
D. 含牙囊肿
E. 牙源性腺样瘤

正确答案：B。成牙骨质细胞瘤

解析：成牙骨质细胞瘤是一种以形成牙骨质样组织为特征的肿瘤，常与一颗牙的牙根相连。掌握“牙源性黏液瘤、成牙骨质细胞瘤”知识点。